细菌芽胞最显著的特性是
A. 抗吞噬性
B. 具有毒素活性
C. 耐热性
D. 粘附性
E. 侵袭性

正确答案：C。耐热性

解析：芽胞是某些细菌在不良环境下形成的休眠体，由于细菌芽胞特殊的结构和组成使得芽胞对热力、干燥、辐射、化学消毒剂等理化因素均具有很强大的抵抗力，进行压力蒸汽灭菌时，应以芽胞是否被杀死作为判断灭菌效果的指标，所以芽胞最显著的特性是耐热性（C对），芽胞不具有毒素活性（B错）。抗吞噬性（A错）、粘附性（D错）是荚膜的功能（P17-P18）。侵袭性（E错）是细菌菌毛的特性（P19）。